下列神经哪条不是发自骶丛
A. 臀上神经
B. 臀下神经
C. 坐骨神经
D. 股神经
E. 阴部神经

正确答案：D。股神经

解析：骶丛的分支主要有臀上神经（A对）、臀下神经（B对）、股后皮神经、阴部神经（E对）、坐骨神经（C对）、胫神经和腓总神经。股神经（D错，为本题正确选项）为腰丛的分支。